水火共制时，需要燀制的中药是
A. 白附子
B. 槐花
C. 苦杏仁
D. 苍术
E. 天南星

正确答案：C。苦杏仁

解析：本题考查的是燀制的中药。水火共制时，需要燀制的中药是苦杏仁（C对）。蒸、煮、燀法为“水火共制”法。燀法是将药物置沸水中浸煮短暂时间，取出，分离种皮的方法。燀制的主要目的：①在保存有效成分的前提下，除去非药用部分，如苦杏仁等。②分离不同药用部位，如白扁豆等。白附子（A错）与天南星（E错）可使用复制法炮制。复制法是将净选后的药物加入一种或数种辅料，按规定操作程序，反复炮制的方法。复制的主要目的：①降低或消除药物的毒性或刺激性，如半夏等。②改变药性，如天南星等。③增强疗效，如白附子等。④矫臭矫味，如紫河车等。槐花（B错）可使用炒炭法炮制。炒炭是将净选或切制后的药物，置炒制容器内，用武火或中火加热，炒至药物表面焦黑色或焦褐色，内部呈棕褐色或棕黄色。炒炭的目的：经炒炭炮制后可使药物增强或产生止血、止泻作用。苍术（D错）可用麸炒法炮制。麸炒是将净制或切制后的药物用麦麸熏炒的方法。麸炒的目的：①增强疗效，如山药、白术、芡实等。②缓和药性，如苍术、枳实、薏苡仁等。③矫臭矫味，如僵蚕等。